右上6缺失，右上7近中倾斜约25°，右上5位置正常，牙槽骨正常，可选择
A. 种植固定桥
B. 固定-可摘联合桥
C. 半固定桥
D. 单端固定桥
E. 双端固定桥

正确答案：C。半固定桥

解析：牙齿近中倾斜，共同就位道获取困难，可以选择使用半固定桥。掌握“固定桥的组成和分类”知识点。